跷脉的功能是
A. 加强足三阴足三阳经脉与心脏的联系
B. 加强体表与体内四肢与躯干的向心性联系
C. 加强十二经脉中相为表里的两经在体内的联系
D. 调节十二经脉的气血
E. 分主一身左右之阴阳

正确答案：E。分主一身左右之阴阳

解析：跷脉分为阴跷脉和阳跷脉，各主一身左右之阴和阳，调和阴阳，司眼睑开合（E对）。十二经别的生理功能：①加强十二经脉表里两经在体内的联系（C错）。②加强体表与体内、四肢与躯干的向心性联系（B错）。③加强足三阴、足三阳经脉与心脏的联系（A错）。④加强了十二经脉和头面部的联系。⑤扩大十二经脉的主治范围。冲脉功能：①调节十二经脉气血（D错）。②与女子月经及生殖功能有关。